糖尿病合并肾病患者宜选用的药物是
A. 胰岛素
B. 格列喹酮
C. 二甲双胍
D. 普伐他汀
E. 阿卡波糖

正确答案：B。格列喹酮

解析：本题考查降糖药。糖尿病合并肾病患者宜选用的药物是格列喹酮（B对）。格列喹酮主要经肝脏代谢，不会增加肾脏负担，因此糖尿病合并肾病者可首选格列喹酮。胰岛素（A错）用于1型糖尿病患者。二甲双胍（C错）用于2型肥胖型糖尿病患者。普伐他汀（D错）用于饮食限制仍不能控制的原发性高胆固醇血症或合并有高甘油三酯血症患者。阿卡波糖（E错）为单纯餐后血糖高的糖尿病患者首选。